药品监督管理部门对《药品经营许可证》持证企业的监督检查内容有
A. 药品专利实施情况
B. 实施《药品经营质量管理规范》的情况
C. 仓库条件的变动情况
D. 经营方式的执行情况
E. 企业内部劳动保障措施

正确答案：B、C、D。实施《药品经营质量管理规范》的情况；仓库条件的变动情况；经营方式的执行情况

解析：本题考查药品监督管理。药品监督管理部门对《药品经营许可证》持证企业监督检查的内容主要包括：（一）企业名称、经营地址、仓库地址、企业法定代表人（企业负责人）、质量负责人、经营方式、经营范围、分支机构等重要事项的执行和变动情况（D对）；（二）企业经营设施设备及仓储条件变动情况（C对）；（三）企业实施《药品经营质量管理规范》情况（B对）；（四）发证机关需要审查的其他有关事项。